损伤后导致右侧舌肌萎缩，伸舌时舌尖偏向右侧
A. 左侧皮质核束
B. 右侧皮质核束
C. 左侧舌下神经核
D. 右侧舌下神经核
E. 左侧舌神经

正确答案：D。右侧舌下神经核

解析：一侧舌下神经核的神经元受损，可致病灶侧全部舌肌瘫痪，表现为伸舌时舌尖偏向病灶侧，所以损伤后导致右侧舌肌萎缩，伸舌时舌尖偏向右侧是右侧舌下神经核（D对）损伤的表现。